处方是
A. 由执业医师为患者开具的，并作为发药凭证的医疗用药的医疗文书
B. 由注册的执业医师和执业助理医师作为发药凭证的医疗用药的医疗文书
C. 由注册的执业医师和执业助理医师在诊疗活动中为患者开具的、由取得药学专业技术职务任职资格的药学专业技术人员审核、调配、核对，并作为患者用药凭证的医疗文书
D. 由执业医师和执业助理医师为患者开具的，并作为发药凭证的医疗用药的医疗文书
E. 由药学专业技术人员审核、调配、核对，并作为发药凭证的医疗用药的医疗文书

正确答案：C。由注册的执业医师和执业助理医师在诊疗活动中为患者开具的、由取得药学专业技术职务任职资格的药学专业技术人员审核、调配、核对，并作为患者用药凭证的医疗文书

解析：处方是指由注册的执业医师和执业助理医师在诊疗活动中为患者开具的、由取得药学专业技术职务任职资格的药学专业技术人员审核、调配、核对，并作为患者用药凭证的医疗文书。处方包括医疗机构病区用药医嘱单。掌握“处方管理概述及一般规定、处方权”知识点。